属于内分泌腺是
A. 甲状腺
B. 肝
C. 前列腺
D. 心
E. 无

正确答案：A。甲状腺

解析：甲状腺（A对）属于内分泌腺，肝（B错）是人体内最大的腺体，也是人体内最大的实质性器官，其分泌的胆汁被肝外胆道系统输送到十二指肠腔，故肝属于外分泌腺。前列腺（C错），是由腺组织和平滑肌组织构成的实质性器官，属于外分泌腺。心（D错）是一个中空的肌性纤维性器官。